皮疹可表现为“四世同堂”的为
A. 麻疹
B. 风疹
C. 幼儿急疹
D. 水痘
E. 猩红热

正确答案：D。水痘